长期缺乏维生素B₁引起的疾病是
A. 坏血病
B. 夜盲症
C. 缺铁性贫血
D. 脚气病
E. 佝偻病

正确答案：D。脚气病

解析：长期缺乏维生素B₁引起的疾病是脚气病（D对），坏血病（A错）由维生素C缺乏引起，夜盲症（B错）由维生素A缺乏引起，缺铁性贫血（C错）由铁缺乏引起佝偻病（E错）由维生素D缺乏引起。